怀疑小儿患脾胃疾病时，特别要注意询问
A. 家族史
B. 生产史
C. 喂养史
D. 生长发育史
E. 预防接种史

正确答案：C。喂养史

解析：小儿具有脾常不足的生理特点，而又乳食不知自调。而且，由于生长发育的需要，须添加辅食。小儿对食物有一个适应的过程。一旦调护喂养失宜，则易患脾胃病。因此，怀疑小儿患脾胃疾病时要特别注意询问喂养史（C对）。家族史、生产史、生长发育史、预防接种史与脾胃疾病关系不大（ABDE错）。